患者因右下后牙遇甜食痛求诊。检查：右下6远中面龋，探敏感，冷热测同对照牙。右下7颊面色素沉着，可卡住探针，冷测同对照牙，诊断为
A. 右下7颊面浅龋，右下6远中面中龋
B. 右下6远中面、右下7颊面中龋
C. 右下7颊面中龋，右下6远中面深龋
D. 右下7颊面浅龋，右下6远中面深龋
E. 以上诊断均不正确

正确答案：A。右下7颊面浅龋，右下6远中面中龋

解析：本题考查龋病。患者因右下后牙遇甜食痛求诊。检查：右下6远中面龋，探敏感，冷热测同对照牙。右下7颊面色素沉着，可卡住探针，冷测同对照牙，诊断为右下7颊面浅龋，右下6远中面中龋（A对）。浅龋患者一般无主观症状，遇温度和化学刺激亦也明显反应，牙体表面粗糙可用探针钩住，可判断右下7为浅龋（B错）。中龋时病变进展到牙本质，探针龋洞稍敏感，遇冷热酸甜刺激可引起酸痛感，温度测验同正常对照牙，根据题干，可知右下6符合中龋的诊断，因此可判断右下6为中龋（A对E错）。当龋病发展到牙本质深层时为深龋，深龋时，食物入洞疼痛，遇冷热和化学刺激产生的疼痛更剧烈，因此可判断左下67均不是深龋（CD错）。